分层分析可减少
A. 选择偏倚
B. 信息偏倚
C. 混杂偏倚
D. 选择偏倚和混杂偏倚
E. 信息偏倚和混杂偏倚

正确答案：C。混杂偏倚

解析：本题考查分层分析可减少的偏倚。分层分析是指把病例组和对照组按可疑的混杂因素分为不同层次，再分别在每一层内分析暴露与疾病的关联强度，从而可以在一定程度上控制混杂因素对研究结果的影响。在资料分析阶段，分层分析可减少混杂偏倚（C对ABDE错）。